I₂污染超标指数
A. 考虑了全年监测数据中超过卫生标准历次浓度的平均值
B. 考虑了全年监测数据中超过卫生标准历次浓度的总和
C. 考虑了全年监测数据中超过和等于卫生标准历次浓度的平均值
D. 考虑了全年监测数据中超过和等于卫生标准历次浓度的总和
E. 仅考虑全年监测数据中超过日平均最高容许浓度的历次浓度总和

正确答案：D。考虑了全年监测数据中超过和等于卫生标准历次浓度的总和

解析：本题考查I₂污染超标指数。I₂污染超标指数考虑了全年监测数据中超过和等于卫生标准历次浓度的总和（D对ABCE错）。它反映了监测期内若干种污染物屡次出现超标高浓度的总状况。